七情致病的一般规律不包括
A. 怒则气上
B. 惊则气逆
C. 喜则气缓
D. 悲则气消
E. 恐则气下

正确答案：B。惊则气逆

解析：七情致病中，喜则气缓（C对），怒则气上（A对），思则气结，悲则气消（D对），恐则气下（E对），惊则气乱（B错，为本题正确答案）。